龈上边缘适用于
A. 金瓷冠的唇侧
B. 老年患者牙龈退缩明显
C. 牙冠短小者
D. 缺损至龈下
E. 以上都不是

正确答案：B。老年患者牙龈退缩明显

解析：本题考查龈上边缘的适用。龈上边缘位于龈上，不与牙龈接触，老年患者牙龈退缩明显（B对），冠根比例不调，若使用龈下边缘，则（牙合）龈距会增大，不利于牙齿健康，有冠折的风险；且老年患者对美观要求不高，使用龈上边缘即可，有利于减少菌斑，保护牙齿和牙周组织。金瓷冠的唇侧（A错）为了美观、不显露金属；牙冠短小者（C错）为了获得足够的（牙合）龈距离；缺损至龈下（D错）为了获得足够固位力，都要使用龈下边缘。